男，68岁。咳嗽20天，胸闷气促1周。20天前受凉后干咳，无发热咯血，自服“板兰根头孢菌素及咳嗽糖浆”，咳嗽稍有减轻，近1周来出现胸闷气促，不能平卧，T37.2℃，P96次/分，R20次/分，BP140/80mmHg，右中下肺语音震颤减弱，叩诊呈浊音，呼吸音减弱，心率100次/分，律齐，腹软，肝脾肋下未触及。该患者最可能的诊断是
A. 胸腔积液
B. 支气管哮喘
C. 肺炎
D. 心力衰竭
E. 肺结核

正确答案：A。胸腔积液

解析：本例患者受凉后咳嗽，胸闷气促，呼吸困难，服“板兰根头孢菌素及咳嗽糖浆”咳嗽稍有所减轻，因此提示有肺部炎症。现右中下肺语音震颤减弱，叩诊呈浊音，呼吸音减弱，根据其临床表现和体征，考虑伴发右侧胸腔积液（A对C错）。支气管哮喘（P29）（B错）典型症状为发作性伴有哮鸣音的呼气性呼吸困难，双肺可闻及广泛的哮鸣音，而本例患者双肺无广泛哮鸣音。心力衰竭（P166）（D错）常有心功能不全的表现，而本例肝脾肋下未触及，呼吸音减弱，未有其他心功能不全的表现。肺结核（P65）（E错）有低热、盗汗、咳嗽，咳血痰等表现，服用头孢菌素无效，且肺结核有实变时肺语颤增强。